对高血压合并心力衰竭者宜选用
A. β受体阻断剂和血管紧张素转换酶抑制剂
B. 血管紧张素转换酶抑制剂或血管紧张素Ⅱ受体阻断剂
C. 硝普钠或硝酸甘油
D. 利尿剂或醛固酮受体拮抗剂
E. α受体阻断剂或利尿剂

正确答案：A。β受体阻断剂和血管紧张素转换酶抑制剂

解析：本题考查抗高血压药。对高血压合并心力衰竭者宜选用β受体阻断剂和血管紧张素转换酶抑制剂（A对）。高血压合并心肌梗死和心力衰竭的患者宜选用β受体阻断剂和血管紧张素转换酶抑制剂（ACEI）或血管紧张素Ⅱ受体拮抗剂（ARB）（B对）。硝普钠或硝酸甘油（C错）用于高血压危象者。利尿剂或醛固酮受体拮抗剂（D错）用于高血压合并脑血管病患者。α受体阻断剂（E错）适用高血压伴前列腺增生患者，心力衰竭者慎用。